具有医学目的的合法用药包括
A. 预防、诊断和治疗疾病
B. 增强体质和身心健康
C. 服用同化激素增长肌肉
D. 服用利尿药减重参加比赛
E. 服用炔诺酮以避免受孕

正确答案：A、B、E。预防、诊断和治疗疾病；增强体质和身心健康；服用炔诺酮以避免受孕